患者，男，22岁。饱餐后出现胃脘胀痛，嗳气吞酸，矢气频作，泻下酸腐臭秽，脉滑，其舌苔多见
A. 薄白苔
B. 薄黄苔
C. 黄腻苔
D. 厚腻苔
E. 白滑苔

正确答案：D。厚腻苔

解析：舌苔厚腻是由于胃气兼夹湿浊、痰浊、食浊等熏蒸，积滞舌面所致。患者饱餐后出现胃脘胀痛，嗳气吞酸，矢气频作，泻下酸腐臭秽，脉滑；可辨证为食滞胃脘证，舌象为厚腻苔（D对）。舌苔薄白而均匀，或中部稍厚，干湿适中，为正常舌苔，提示胃有生发之气。若在病中，说明病情轻浅，未伤胃气（A错）。舌苔由白转黄，或呈黄白相兼，多为外感表证处于化热入里，表里相兼阶段（B错）。黄苔而质腻者，称黄腻苔，主湿热或痰热内蕴，或为食积化腐（C错）。苔薄白而滑，多为外感寒湿，或脾肾阳虚，水湿内停（E错）。